用于调节缓释制剂中药物释放速度的是
A. β-环糊精
B. 液状石蜡
C. 羊毛脂
D. 七氟丙烷
E. 硬脂醇

正确答案：E。硬脂醇

解析：本题考查骨架型缓释材料。溶蚀性骨架材料是指疏水性强的脂肪类或蜡类物质，如动物脂肪、蜂蜡、巴西棕榈蜡、氢化植物油、硬脂醇（E对）、单硬脂酸甘油酯、硬脂酸丁酯等，可延滞水溶性药物的溶解、释放过程。β-环糊精（A错）是制备包合物的包合材料。液体石蜡（B错）为液体制剂中常用的非极性溶剂。羊毛脂（C错）是W/O型乳膏剂常用的乳化剂。七氟丙烷（D错）可作为气雾剂的抛射剂。